属于Ⅲ型超敏反应的疾病是
A. 支气管哮喘
B. 血清病
C. 药物过敏性休克
D. 接触性皮炎
E. 自身免疫性溶血性贫血

正确答案：B。血清病

解析：Ⅲ型超敏反应是由可溶性免疫复合物沉积于局部或全身多处毛细血管基底膜后，通过激活补体，并在中性粒细胞、血小板、嗜碱性粒细胞等效应细胞参与下，引起的以充血水肿、局部坏死和中性粒细胞浸润为主要特征的炎症反应和组织损伤。临床常见的Ⅲ型超敏反应性疾病有局部免疫复合物病（arthus反应和类arthus反应）和全身性免疫复合物病（血清病（B对）、链球菌感染后肾小球肾炎和类风湿性关节炎）。支气管哮喘（A错）、药物过敏性休克（C错）属于Ⅰ型超敏反应（P148）。接触性皮炎为典型的Ⅳ型超敏反应（D错）（P154）。自身免疫性溶血性贫血为Ⅱ型超敏反应（E错）（P150）。